属于Ⅲ型超敏反应性疾病的是
A. 过敏性溶血性贫血
B. SLE
C. 过敏性鼻炎
D. 结核
E. 青霉素引起的过敏性休克

正确答案：B。SLE